传导速度最快的是
A. 窦房结
B. 心房肌
C. 房室交界
D. 心室肌
E. 普肯耶纤维

正确答案：E。普肯耶纤维